抗高血压的药是
A. 酮康唑
B. 培哚普利
C. 利多卡因
D. 法莫替丁
E. 卡马西平

正确答案：B。培哚普利

解析：本题考查抗高血压药。抗高血压的药是培哚普利（B对）。培哚普利为血管紧张素转换酶抑制剂，可使外周血管阻力降低，而心输出量和心率不变，用于治疗各种高血压与充血性心力衰竭。酮康唑（A错）为广谱抗真菌药。利多卡因（C错）属于Ⅰb类抗心律失常药。法莫替丁（D错）为组胺H₂受体阻断剂。卡马西平（E错）为二苯并氮䓬类抗癫痫药。